某化工厂周边近十几年来发生不明原因精神障碍和共济失调等现象的居民逐渐增多，甚至有些居民出现急性肾衰竭。以上现象最可能是
A. 汞中毒
B. 镉中毒
C. 砷中毒
D. 铅中毒
E. 有机磷中毒

正确答案：A。汞中毒